吸收的主要部位不包括
A. 胃肠道
B. 呼吸道
C. 肝
D. 皮肤

正确答案：C。肝

解析：本题考查吸收的主要部位。吸收是化学毒物从机体的接触部位透过生物膜进入血液的过程。吸收的主要部位是胃肠道（A对）、呼吸道（B对）和皮肤（D对）。肝（C错，为本题正确答案）不是吸收的部位。